某男，60岁。患瘰疬10年，近5年时发偏头痛与头疮，曾多方诊治而乏效，遂就诊于某中医。医师在处方中投以全蝎，此因该药除息风止痉、攻毒散结外，又能
A. 活血祛瘀
B. 通络止痛
C. 通络利尿
D. 清利头目
E. 平肝化痰

正确答案：B。通络止痛

解析：本题考查的是全蝎的功效。患瘰疬10年，近5年时发偏头痛与头疮，曾多方诊治而乏效，遂就诊于某中医。医师在处方中投以全蝎，此因该药除息风止痉、攻毒散结外，又能通络止痛（B对）。全蝎：【功效】息风止痉，攻毒散结，通络止痛。北刘寄奴：【功效】活血祛瘀（A错），通经止痛，凉血止血，清热利湿。地龙：【功效】清热息风，平喘，通络，利尿（C错）。薄荷：【功效】宣散风热，清利头目（D错），利咽，透疹，疏肝。功效为平肝化痰（E错）的中药，2022年考试指南未明确说明。